小儿化脓性淋巴结炎常因何种感染引发
A. 牙源性
B. 血源性
C. 损伤性
D. 腺源性
E. 医源性

正确答案：D。腺源性

解析：本题考查面颈部淋巴结炎。小儿化脓性淋巴结炎常因腺源性（D对）感染引发。小儿患者大多数由上呼吸道感染及扁桃体炎引起，由化脓性细菌如葡萄球菌及链球菌等引起的称为化脓性淋巴结炎。